推荐剂量下常见胃肠道不良反应的是
A. 阿司匹林
B. 法莫替丁
C. 葡萄糖酸钙
D. 碱式硝酸铋复方制剂
E. 盐酸异丙嗪（非那根）

正确答案：A。阿司匹林

解析：本题考查阿司匹林。阿司匹林（A对）为非选择性环氧酶（COX）抑制剂，由于缺乏选择性，抑制了胃壁处的COX-1，引起消化道溃疡、出血等不良反应；法莫替丁（B错）为组胺H₂受体阻滞药，抑制胃酸、胃蛋白酶的分泌，对动物实验性溃疡有一定保护作用；葡萄糖酸钙（C错）主要治疗钙缺乏，口服钙剂一般无不良反应，静脉给药时可能出现全身发热感，静脉速度过快时，可产生心律失常，恶心和呕吐；碱式硝酸铋复方制剂（D错）为胃黏膜保护剂；异丙嗪（E错）用于多种过敏，主要不良反应为锥体外系症状、眩晕、乏力、紧张症、癔症、心动过速或过缓、血压升高或降低等。